出现“米猪肉”的病原是
A. 无钩绦虫
B. 有钩绦虫
C. 无钩绦虫幼虫
D. 有钩绦虫幼虫
E. 猪弓形虫

正确答案：D。有钩绦虫幼虫

解析：本题考查“米猪肉”的病原。“米猪肉”是由于猪被有钩绦虫卵感染之后，绦虫的幼虫在猪肉中形成许多肉眼为白色，绿豆大小，半透明水泡状囊而命名，其病原是有钩绦虫幼虫（D对ABCE错）。